非处方药的特点是
A. 购买时不需医师处方
B. 给药途径以口服、外用为主
C. 只在药店、超市销售
D. 不在专业（医药）期刊登广告
E. 没有新药专利保护

正确答案：A、B、D。购买时不需医师处方；给药途径以口服、外用为主；不在专业（医药）期刊登广告